病因不明的急性腹膜炎行剖腹探查时，手术切口一般多选择
A. 左旁正中
B. 右肋下缘
C. 左肋下缘
D. 正中
E. 右旁正中

正确答案：E。右旁正中

解析：病因不明的急性腹膜炎行剖腹探查时，手术切口一般多选择右旁正中切口（E对），开腹后可以向上向下延长，方便探查腹腔内所有脏器。左旁正中（A错）、左肋下缘切口（C错）多用于脾切除术。右肋下缘切口常用于肝、胆手术（B错）。正中切口一般用于不明原因的腹部损伤( D错)。